肾病综合征患儿，口服泼尼松2mg/kg·d，治疗8周后尿蛋白仍（++++）。疗效判断为
A. 复发
B. 激素敏感
C. 激素耐药型
D. 激素依赖型
E. 激素部分敏感型

正确答案：C。激素耐药型

解析：肾病综合征（NS）是指由多种原因引起的肾小球基底膜通透性增加，导致血浆内大量蛋白质从尿中丢失的临床综合征。大量蛋白尿、低白蛋白血症、高脂血症、明显水肿是其临床特点。该患儿口服泼尼松（糖皮质激素）治疗8周后，尿蛋白仍（++++）（尿蛋白＞（+++）判定为未缓解，即治疗无效），为激素耐药型（C对）。复发（A错）是指进入恢复期，已稳定一段时间后，原本已转阴的尿蛋白再次转为阳性。激素敏感型（B错）指用药8～12周内NS缓解。激素依赖型（D错）是指激素起始治疗有效，尿蛋白转阴，但减量到一定程度后复发，尿蛋白再次转阳。激素部分敏感型（E错）指治疗部分缓解，尿蛋白下降，但未完全转阴。